Ⅱ型超敏反应又称为
A. 速发型超敏反应
B. 细胞毒型超敏反应
C. 免疫复合物型
D. 迟发型超敏反应
E. 适应型超敏反应

正确答案：B。细胞毒型超敏反应

解析：Ⅱ型超敏反应又称为溶细胞型或细胞毒型超敏反应。掌握“概述及Ⅰ型超敏反应”知识点。